口腔是消化管的起始部，向前经口裂通于外界，向后经咽峡通于咽，上界为腭，下界为口腔底，两侧壁为颊。关于口唇的描述，正确的是
A. 上界为鼻唇沟
B. 上、下唇内面正中线处有上、下唇系带
C. 以系带为界可分为前、后2部
D. 以颊肌为基础，内衬黏膜
E. 口角约平对第3磨牙

正确答案：B。上、下唇内面正中线处有上、下唇系带

解析：口唇上界为鼻底线(A错)，在上、下唇内面正中线处有上、下唇系带(B对)，以系带为界可分为左、右2部(C错)，以口轮匝肌为基础内衬黏膜(D错)，口角平对第1磨牙(E错)。